男性，16岁。能量供给量为2900kcal，蛋白质提供的热能占总热能的12%。该学生维生素B₁的供给量应是
A. 0.6mg
B. 1.0mg
C. 1.2mg
D. 1.5mg
E. 1.8mg

正确答案：D。1.5mg